腹主动脉的壁支有
A. 脐动脉
B. 腰动脉
C. 腹壁上动脉
D. 腹壁下动脉
E. 肋间后动脉

正确答案：B。腰动脉

解析：腰动脉（B对）、膈下动脉、骶正中动脉均为腹主动脉的壁支。